患者妊娠70天，阴道少量下血，色鲜红，腰酸，口干心烦，小便黄，大便秘结，舌红，苔黄，脉滑数。治疗应首选的方剂是
A. 清经散
B. 两地汤
C. 寿胎丸
D. 保阴煎
E. 胎元饮

正确答案：D。保阴煎

解析：患者妊娠70天，阴道少量下血，腰酸，应考虑胎漏、胎动不安；色鲜红，口干心烦，小便黄，大便秘结，舌红，苔黄，脉滑数为血热证表现，治法清热凉血，养阴安胎，处方保阴煎（D对），此方来源于《景岳全书》原方治男、妇带、浊、遗、淋，色赤带血，脉滑多热，便血不止，及血崩血淋，或经期太早等阴虚内热动血证。清经散主治肾中水亏火旺，阳盛血热，经行先期量多者（A错）。两地汤功用滋阴清热主治肾水不足，虚热内炽，月经先期，量少色红，质稠粘，伴有潮热、盗汗，咽干口燥，舌红苔少，脉细数无力者（B错）。胎漏、胎动不安之肾虚证用寿胎丸（C错）。胎漏、胎动不安之证用胎元饮（E错）。